某女，4岁。壮热烦躁，面红，大汗出，口渴喜冷饮，尿少色黄便秘；舌红，苔黄，脉数。该患儿体温进一步升高，出现手足厥冷，脉沉伏有力。根据病情变化的辨证结果，宜采用的治法是
A. 以热治热
B. 以寒治热
C. 以寒治寒
D. 以热治寒
E. 用热远热

正确答案：C。以寒治寒

解析：本题考查的是反治的内容。壮热烦躁，面红，大汗出，口渴喜冷饮，尿少色黄便秘；舌红，苔黄，脉数。该患儿体温进一步升高，出现手足厥冷，脉沉伏有力。根据病情变化的辨证结果，宜采用的治法是以寒治寒（C对）。正治与反治：正治，又称逆治，是指采用方药的性质与疾病的证候性质相反的治疗法则。正治，适用于临床表现与疾病证候本质相一致的病证。常用的治法有寒者热之、热者寒之、虚则补之、实则泻之等。1.寒者热之：寒者热之又称“以热治寒（D错）”，是指寒性病证出现寒象，用温热方药进行治疗。如表寒证用辛温解表方药，里寒证用辛热温里方药等。2.热者寒之：热者寒之又称“以寒治热（B错）”，是指热性病证出现热象，用寒凉方药进行治疗。如表热证用辛凉解表方药，里热证用苦寒清里方药治疗等。3.虚则补之：虚则补之是指虚损性病证出现虚象，用补益方药进行治疗。如阳虚用温阳方药；阴虚用滋阴方药；气虚用补气方药；血虚用补血方药等。4.实则泻之：实则泻之是指实性病证出现实象，用攻逐邪实的方药进行治疗。如气滞用理气行滞方药，食滞胃脘用消食导滞方药，水饮停留用逐水方药，瘀血用活血化瘀方药等。反治，又称从治，是指顺从疾病证侯的外在假象而治的治疗法则。反治，适用于临床表现与疾病证候本质不完全一致的病症。反治，主要包括热因热用、寒因寒用、塞因塞用、通因通用四种治法。1.热因热用：热因热用又称“以热治热（A错）”，是指针对假热的临床表现，用热性药物来进行治疗。适用于阴寒内盛、格阳于外，反见假热之象的真寒假热证。2.寒因寒用：寒因寒用又称“以寒治寒”，是指针对假寒的临床表现，用寒性药物进行治疗。适用于里热盛极、阳盛格阴，反见假寒之象的真热假寒证。3.塞因塞用：塞因塞用又称“以补开塞”，是指针对闭塞不通的临床表现，用补虚药物进行治疗。适用于因虚而出现闭塞不通假象的真虚假实证。如脾虚腹胀、血虚经闭等。4.通因通用：通因通用又称“以通治通”，是指针对通泄的临床表现，用通利药物进行治疗。适用于因实而出现通利假象的真实假虚证。如热结旁流、湿热淋证、瘀血崩漏等。用热远热（E错）属于因时制宜。用热远热：夏季，气候炎热，人体腠理疏松，阳气偏盛，应避免过用热性药物，以免耗伤气阴。